下列关于肿瘤的免疫治疗叙述不正确的是
A. 治疗非特异性免疫增强剂可发挥抗肿瘤作用
B. 肿瘤的主动免疫是应用肿瘤疫苗对肿瘤进行预防或治疗的方法
C. 给机体输注外源性的免疫分子或免疫细胞治疗肿瘤的方法称为肿瘤的被动免疫治疗
D. 靶向CD20的基因工程抗体被用于乳腺癌的治疗
E. 肿瘤的免疫治疗分为非特异性免疫、主动免疫治疗、被动免疫治疗

正确答案：D。靶向CD20的基因工程抗体被用于乳腺癌的治疗

解析：①非特异性免疫治疗：非特异性免疫增强剂可发挥抗肿瘤作用，如卡介菌和咪喹莫特（imiquimod）。②主动免疫治疗：肿瘤的主动免疫是应用肿瘤疫苗对肿瘤进行预防或治疗的方法。采用前列腺酸性磷酸酶，粒细胞单核细胞集落刺激因子融合蛋白加载的人外周血单个核细胞疫苗已被批准治疗晚期前列腺癌。采用重组HPVL1蛋白制备的预防子宫颈癌的疫苗已在美国和欧洲上市。③被动免疫治疗：给机体输注外源性的免疫分子或免疫细胞治疗肿瘤的方法被称为肿瘤的被动免疫治疗。靶向人类表皮生长因子受体-2（HER-2）的基因工程抗体被用于治疗乳腺癌。靶向CD20的基因工程抗体被用于B细胞淋巴瘤的治疗。靶向表皮生长因子受体（EGFR）的基因工程抗体被用于治疗转移性结直肠癌。重组IFN-α被用来治疗毛细胞白血病。重组IL-2被用来治疗转移性黑色素瘤。将在体外扩增和激活的患者的肿瘤特异性T细胞将其回输后可产生抗肿瘤作用。掌握“肿瘤免疫”知识点。